患儿，男，9岁。头皮部初起丘疹色红，灰白色鳞屑成斑，毛发干枯，容易折断，易于拔落而不疼痛，已有年余，自觉瘙痒。其诊断是
A. 肥疮
B. 牛友癣
C. 白秃疮
D. 白庀
E. 圆癣

正确答案：C。白秃疮

解析：肥疮相当于西医的黄癣，多见于农村，好发于儿童。皮损多从头顶部开始，渐及四周，可累及全头部。初起红色丘疹，或有脓疱，干后结痂蜡黄色，愈后局部有脱发，题中患儿为灰白色鳞屑成斑，无干后结痂蜡黄色（A错）。牛皮癣是一种皮肤状如牛项之皮，厚且坚的慢性瘙痒性皮肤病，多发于青壮年，多发于颈部、额部，其次为尾骶、肘窝、腘窝，亦可见于腰背，两髋、外阴、肛周、腹股沟及四肢等处，常呈对称性分布，题中患儿发于头部，无厚且坚的皮损，有断发现象（B错）。白秃疮相当于西医的白癣，多见于学龄儿童，男性多于女性。皮损特征是在头皮有圆形或不规则的覆盖灰白鳞屑的斑片、病损区毛发干枯无泽，常在距头皮0.3~0.8cm处折断而参差不齐。头发易于拔落且不疼痛，病发根部包绕有白色鳞屑形成的菌鞘，自觉瘙痒，题中患儿与白秃疮的症状相符（C对）。白庀皮损多为较厚的银白色鳞屑性斑片，头发呈束状，刮取鳞屑可见渗血点，无断发现象（D错）。圆癣相当于西医的体癣，皮损多呈钱币状、圆形，故名圆癣，以青壮年男性多见，多发于夏季，好发于面部、颈部、躯干及四肢近端。圆癣初起为丘疹或水疱，逐渐形成边界清楚的钱币形红斑，其上覆盖细薄鳞屑。圆癣的皮损特征为环形或多环形、边界清楚、中心消退、外围扩张的斑块。斑块一般为钱币大或更大，多发时可相互融合形成连环形。自觉瘙痒，搔抓日久皮肤可呈苔藓样变，病情多在夏季发作或扩大，入冬痊愈或减轻，题中患儿皮损呈钱币状、圆形的典型表现（E错）。